超过有效期的药品是
A. 劣药
B. 假药
C. 残次药品
D. 仿制药品
E. 特殊管理药品

正确答案：A。劣药

解析：超过有效期的药品是劣药。成份含量不符合国家药品标准的药品，被污染的药品，未标明或者更改有效期、超过有效期、未注明或者更改产品批号的药品，擅自添加防腐剂和辅料的药品，其他不符合药品标准的药品称为劣药（A对C错）。假药所含成份与国家药品标准规定的成份不符的药品，以非药品冒充药品或者以他种药品冒充此种药品，变质的药品，所标明的适应症或者功能主治超出规定范围的药品（B错）。仿制药品是指仿制国家已批准正式生产、并收载于国家药品标准（包括《中国生物制品规程》）的品种（D错）。麻醉药是国家实行特殊管理的药品（E错）。